对脾脏肿大与腹腔肿块的鉴别，最有意义的是
A. 质地
B. 大小
C. 活动度
D. 有无压痛
E. 有无切迹

正确答案：E。有无切迹

解析：对脾脏肿大与腹腔肿块的鉴别，最有意义的是有无切迹。肿大的脾脏随呼吸运动而上下移动，中度肿大以上时脾右前正中线缘常可触到脾切迹。腹腔肿块：如果腹膜刺激征阴性，腹部有压痛，可考虑腹壁病变或深部炎症或肿块（E对）。肿块质地：若为实质性，质地可以柔软、中等或坚硬，见于炎症或肿瘤；若为囊性，触之柔软，见于囊肿或脓肿（A错）。触及肿块，都应测量其纵、横径及前后径，或形象地比喻为鸡蛋、拳头大小等，以利于动态观察（B错）。肝、脾、胆囊、胃、肾或其肿物可随呼吸而上下移动（C错）。炎性包块压痛明显（D错）。